在《中国药典》中，葡萄糖注射液的检查项目有
A. 吸光度
B. 5-羟甲基糖醛
C. 半乳糖
D. 顺式异构体
E. 分子量与分子量分布

正确答案：B。5-羟甲基糖醛

解析：本题考查葡萄糖注射液的检查项目。葡萄糖注射液的检查项目包括5-羟甲基糖醛（B对）及pH。